男，61岁。2周来水肿，尿中泡沫多，尿红细胞（﹣）。查血清白蛋白30.5g/L，24小时尿蛋白定量5.0g。最有可能的病理类型是
A. 微小病变肾病
B. 膜性肾病
C. FSGS
D. 膜增生性肾炎
E. 毛细血管内增生性肾炎

正确答案：B。膜性肾病